在上颌基托前腭区设计模拟腭皱的目的是
A. 制作仿真义齿
B. 美观
C. 有助于发音
D. 口感舒适
E. 增加基托强度

正确答案：C。有助于发音

解析：本题考查腭皱的作用。全口义齿上颌基托会覆盖整个上颚向后到达后堤区，基托前腭区要模拟腭皱是为了模拟腭皱的功能，有助于辅助发音（C对）。制作仿真义齿（A错）是为了美观，美观主要是指外露部分，如前牙的排列，对于上腭部分来说美观不是目的（B错）。口感舒适（D错）是与基托的厚度、人工牙的排列有关，与模拟腭皱无关。增加基托强度（E错）是靠增加基托厚度和嵌入钢丝，与模拟腭皱无关。